某男子因每早刷牙时牙出血来就医，医生检查发现牙龈肿胀，牙床溃烂、牙齿松动、全身内出血，皮下大片发绀，血液渗入关节腔使关节增大，骨骼畸形弯曲，贫血，肌肉纤维萎缩，此病可能为
A. 牙周炎
B. 骨软化症
C. 脚气病
D. 坏血病
E. 癞皮病

正确答案：D。坏血病